妇人腹痛气滞血瘀证的治法是
A. 温肾助阳，暖宫止痛
B. 行气活血，化瘀止痛
C. 补血养营，和中止痛
D. 清热除湿，化瘀止痛
E. 散寒除湿，化瘀止痛

正确答案：B。行气活血，化瘀止痛

解析：妇人腹痛气滞血瘀证治疗时要用膈下逐瘀汤活血化瘀，理气止痛（B对）。温肾助阳，暖宫止痛多用于肾阳虚，宫寒的妇人腹痛证（A错）。补血养营，和中止痛多用于血虚，冲任失于濡养的妇人腹痛证（C错）。清热除湿，化瘀止痛多用于治疗湿热瘀结的妇人腹痛证（D错）。散寒除湿，化瘀止痛多用于寒湿凝滞，瘀阻胞宫的妇人腹痛证（E错）。